下列不属于传染病防控工作伦理要求的是（医学伦理学）
A. 采取走访患者家庭以预防医患冲突
B. 做好传染病的监测和报告
C. 尊重传染病患者的人格和权利
D. 尊重科学事实
E. 开展传染病的预防宣传教育

正确答案：A。采取走访患者家庭以预防医患冲突

解析：传染病防控工作的伦理要求是：严格执行隔离消毒措施和各项操作规程；坚持预防为主的积极防疫思想，尊重科学事实（D对），开展传染病的预防宣传教育（E对）；尊重传染病病人的人格和权利（C对）；遵守国家法律规定，主动做好传染病的监测和报告（B对），及时收集与上报疫情。采取走访患者家庭以预防医患冲突（A错，为本题正确答案）时医患工作的要求，不属于传染病防控工作伦理要求。